独语，病因多属
A. 热扰心神
B. 痰火扰心
C. 风痰阻络
D. 心气不足
E. 心阴大伤

正确答案：D。心气不足

解析：独语多因心气虚弱，神气不足，或气郁痰阻，蒙蔽心神所致，属阴证（D对）。谵语指神识不清，语无伦次，声高有力的症状。多属邪热内扰心神所致，属实证（A错）。狂言指精神错乱，语无伦次，狂叫骂詈的症状。多因情志不遂，气郁化火，痰火互结，内扰神明所致（B错）。病中言语謇涩，每与舌强并见，多因风痰阻络所致（C错）。心阴大伤可致心悸失眠，一般不会导致病态语言（E错）。